因分子中含有易代谢的双酯结构而作用时间短的非去极化型肌肉松弛药
A. 苯磺顺阿曲库铵
B. 噻托溴铵
C. 毒扁豆碱
D. 异丙托溴铵
E. 溴新斯的明

正确答案：A。苯磺顺阿曲库铵

解析：本题考查肌松药。苯磺顺阿曲库铵（A对）分子中含有体内易代谢的双酯结构，作用与筒箭毒碱相同，但起效快（1分钟）、持续时间短（15分钟）。治疗剂量时不影响心、肝、肾功能。无蓄积性。大剂量时可促使组胺释放，属于中效竞争性肌松药。噻托溴铵（B错）和异丙托溴铵（D错）为平喘药。毒扁豆碱（C错）为毒扁豆碱为抗胆碱酯酶药，临床上主要有缩瞳、降低眼压作用。溴新斯的明（E错）为抗胆碱酯酶药，用于重症肌无力，腹部术后的肠麻痹和尿潴留。